酚妥拉明治疗抗休克时不可出现的是
A. 可舒张血管，降低外周阻力
B. 心输出量减少
C. 适用于感染性、心源性和神经源性休克
D. 使用前酚妥拉明必须补足血容量
E. 可降低肺循环阻力

正确答案：B。心输出量减少

解析：本题考查α肾上腺素受体阻断剂。酚妥拉明治疗抗休克时可舒张血管，降低外周阻力（A对），使心输出量增加（B错，为本题正确答案），并能降低肺循环阻力（E对），防止肺水肿的发生，从而改善休克状态时的内脏血液灌注，解除微循环障碍。尤其对休克症状改善不佳而左室充盈压增高者疗效好。适用于感染性、心源性和神经源性休克（C对）。但给药前必须补足血容量（D对）。